人体是否发生职业病，不取决于
A. 个体的健康状况
B. 劳动方式
C. 有害因素的性质
D. 有害因素的浓度和强度

正确答案：B。劳动方式

解析：本题考查职业病的发病条件。职业病的发病取决于以下三个条件：（1）有害因素的性质（C对）；（2）有害因素的浓度和强度（D对）；（3）个体的健康状况（A对）。劳动方式（B错，为本题正确答案）不是决定是否发生职业病的条件。